有关脾的描述，错误的是
A. 具有存贮血细胞、产生抗体的功能
B. 为椭圆形中空器官
C. 位于左季肋区
D. 上缘有2－3个小切迹
E. 内侧面有脾血管出入的脾门

正确答案：B。为椭圆形中空器官

解析：脾具有存贮血细胞和进行免疫应答，即产生抗体的功能（A对）。脾为实质性器官（B错，为本题正确答案）。脾位于左季肋区（C对），脾上缘前部有2~3个脾切迹（D对），是脾肿大是触诊脾的标志，脾内侧面有脾血管出入的脾门（E对），此外脾门还有神经、淋巴管出入。